26岁未产妇，停经48日后出现阴道少量流血伴右下腹隐痛。今晨起床时突然右下腹剧痛来院。检査：血压90/60mmHg，面色苍白，下腹稍膨隆，右下腹压痛明显，肌紧张不明显，叩诊移动性浊音（±）。妇科检査：子宫稍大稍软，右附件区触及有压痛包块。恰当诊断应是
A. 输卵管妊娠流产
B. 输卵管间质部妊娠破裂
C. 急性阑尾炎
D. 急性输卵管炎
E. 右侧卵巢囊肿蒂扭转

正确答案：A。输卵管妊娠流产

解析：育龄期女性，停经48日（输卵管妊娠多有6～8周停经史）后出现阴道少量流血伴右下腹隐痛，晨起床时突然右下腹剧痛（输卵管妊娠典型症状为停经后腹痛与阴道流血，流产或破裂前常表现为一侧下腹部隐痛或酸胀感）。查体右附件区触及有压痛包块（输卵管妊娠流产或破裂时所形成的血肿凝固与周围组织或器官发生粘连形成包块），血压90/60mmHg（休克时收缩压＜90mmHg，此患者未达到休克诊断标准），叩诊移动性浊音（±）（表明出血量不大，输卵管妊娠流产时出血一般不多），故考虑为输卵管妊娠流产（A对）。输卵管间质部妊破裂（P53）（B错）常发生于孕12～16周，由于管腔周围肌层较厚，血运丰富，一但破裂，犹如子宫破裂，症状极严重，往往在短时间内出现低血容量休克症状。急性阑尾炎（C错）典型表现为转移性右下腹痛；急性输卵管炎（P261）（D错）常见症状为下腹痛、阴道分泌物增多，严重者可出现高热、寒战、头痛等表现；卵巢囊肿蒂扭转（P323）（E错）表现为体位改变后下腹的疼痛，均无停经、阴道流血表现。